关于高压蒸汽灭菌法，不正确的描述是
A. 灭菌效果最可靠
B. 适用于对耐高温和耐湿物品的灭菌
C. 可杀灭包括细菌芽胞在内的所有微生物
D. 通常灭菌压力为2.05Kg/cm²
E. 通常灭菌温度为121.3℃

正确答案：D。通常灭菌压力为2.05Kg/cm²

解析：压力蒸汽灭菌法（八版外科学P6称为高压蒸汽灭菌法）属于物理消毒法中的湿热灭菌法，常用于一般培养基、生理盐水、手术敷料等耐高温、耐湿热、物品的灭菌（B对），可杀灭包括细菌芽胞在内的所有微生物（C对）。高压蒸汽灭菌法是目前医院内应用最多的灭菌法，灭菌效果最可靠（A对）。通常在超过标准大气压103.4kPa（1.05kg/cm²）（D错，为本题正确答案）蒸汽压下，温度达到121.3℃（E对），维持15～20分钟，便可杀灭包括细菌芽胞在内的所有微生物，达到灭菌要求。